下列关于T细胞活化的第二信号的描述中，正确的是
A. CD4与MHC-Ⅱ分子间的互相作用
B. CD8与MHC-Ⅰ分子间的互相作用
C. TCR-CD3复合物与抗原肽-MHC复合物间相互作用
D. IL-2与相应受体间的相互作用
E. 协同刺激分子与相应受体间的相互作用

正确答案：E。协同刺激分子与相应受体间的相互作用

解析：抗原与B细胞的BCR结合产生的信号为B细胞活化的第一信号，但B细胞的充分活化还需要Th细胞和B细胞表面的协同刺激分子相互作用产生的第二信号。掌握“T淋巴细胞”知识点。